根据《药品经营许可管理办法》，不符合开办药品零售企业设置规定的是
A. 具有保证所经营药品质量的规章制度
B. 质量负责人应有一年以上（含一年）药品经营质量管理工作的经验
C. 大型药品零售连锁企业可以从事第一类精神药品零售业务
D. 在超市内设立零售药店的，必须具有独立的区域
E. 具有配备当地消费者所需药品的能力

正确答案：C。大型药品零售连锁企业可以从事第一类精神药品零售业务

解析：本题考查的是药品零售企业不得经营的药品种类。药品零售企业不得经营第一类精神药品（C错，为本题正确答案）。药品零售企业不得经营的药品种类：药品零售企业不得经营的药品：麻醉药品、放射性药品、第一类精神药品、终止妊娠药品（包括含有“米非司酮”成分的所有药品制剂）、蛋白同化制剂、肽类激素（胰岛素除外）、药品类易制毒化学品、疫苗，以及我国法律法规规定的其他禁止零售的药品。药品零售企业也不得经营中药配方颗粒、医疗机构制剂。药品零售企业（含药品零售连锁门店）的开办条件：从事药品零售活动，应当具备以下条件：（1）经营处方药、甲类非处方药的，应当按规定配备执业药师或者其他依法经过资格认定的药学技术人员；经营乙类非处方药的，应当根据省、自治区、直辖市药品监督管理部门的规定配备药学技术人员；企业法定代表人、主要负责人、质量管理负责人（以下称质量负责人）无《药品管理法》规定的禁止从事药品经营活动的情形。（2）具有与所经营药品相适应的营业场所、设备、计算机系统、陈列（仓储）设施设备以及卫生环境；在超市等其他场所从事药品零售活动的，应当具有独立的经营区域（D对）。（3）具有独立的计算机管理信息系统，能覆盖企业药品经营和质量控制全过程，并实现药品信息化追溯。（4）具有保证药品质量的规章制度（A对），并符合药品GSP的要求。